属于黏膜免疫系统的免疫器官是
A. 胸腺
B. 脾脏
C. 扁桃体
D. 骨髓
E. 肝脏

正确答案：C。扁桃体

解析：免疫器官按其发生和功能不同，可分为中枢免疫器官（骨髓和胸腺）和外周免疫器官（淋巴结、脾和黏膜相关淋巴组织）。黏膜免疫器官是指呼吸道、胃肠道及泌尿生殖道黏膜固有层和上皮细胞下散在的无被膜淋巴组织，以及含有生发中心的器官化的淋巴组织，如扁桃体（C对）、小肠派尔集合淋巴结及阑尾等，是发生黏膜免疫应答的主要部位。胸腺（A错）和骨髓（D错）属于中枢免疫器官，是免疫细胞发生、分化和成熟的场所。脾脏（B错）属于外周免疫器官，是T、B细胞定居的场所，可发生免疫应答，不属于黏膜免疫系统。肝脏（E错）是体内以代谢功能为主的一个器官，具有生物转化的作用，不属于免疫器官。